新生儿败血症的产时感染的途径是
A. 孕母有菌血症
B. 阴道细菌上行
C. 脐部感染
D. 消化道入侵
E. 黏膜破损

正确答案：B。阴道细菌上行

解析：新生儿感染发生在出生时感染时可有胎儿通过产道时接触、吸入污染的分泌物或血液中的病原体；胎膜早破、产程延长、分娩时消毒不严或有创胎儿监护及窒息复苏等均可导致胎儿感染（B对）。